改善泌尿生殖系统绝经综合征，首选的药物是
A. 甲硝唑
B. 克林霉素
C. 克霉唑
D. 孕激素
E. 雌激素

正确答案：E。雌激素

解析：本题考查雌激素。改善泌尿生殖系统绝经综合征，首选的药物是雌激素（E对）。仅为改善泌尿生殖系统绝经综合征时，建议首选阴道局部雌激素治疗；当口服或经皮MHT不能完全改善泌尿生殖道局部症状时，可同时加用局部雌激素治疗。滴虫性阴道炎首选甲硝唑（A错）。对炎症突出的痤疮，轻、中度者可选维A酸和克林霉素（B错）磷酸酯凝胶外用治疗。外阴阴道假丝酵母菌病可选用抗真菌药物如克霉唑（C错）、咪康唑、制霉菌素等药物进行治疗。